善治肠痈腹痛的药是
A. 红藤
B. 马齿苋
C. 山豆根
D. 野菊花
E. 白花蛇舌草

正确答案：A。红藤

解析：本题考查的是大血藤的主治病证。善治肠痈腹痛的药是红藤（A对）。红藤即大血藤。大血藤：【主治病证】（1）肠痈腹痛，痈肿疮毒。（2）跌打损伤，痛经，闭经，产后瘀阻。（3）风湿痹痛。马齿苋（B错）：【主治病证】（1）热毒血痢，热毒疮疡。（2）血热崩漏、便血。（3）热淋，血淋。山豆根（C错）：【主治病证】（1）火毒蕴结之咽喉肿痛，肺热咳嗽。（2）牙龈肿痛，痈肿疮毒，湿热黄疸。野菊花（D错）：【主治病证】（1）疔疮痈肿。（2）风热感冒，咽喉肿痛。（3）目赤肿痛，头痛眩晕。白花蛇舌草（E错）：【主治病证】（1）痈肿疮毒，咽喉肿痛，肠痈，毒蛇咬伤。（2）热淋涩痛，小便不利。（3）胃癌，食管癌，直肠癌。